干姜配伍附子，可降低附子的毒性，属于
A. 相须
B. 相使
C. 相畏
D. 相杀
E. 相反

正确答案：D。相杀

解析：该题主要考查中药“七情”配伍理论。相杀就是一种药物能够消除另一种药物的毒副作用（D对）。相须就是两种功效类似的药物配合应用，可以增强原有药物功效（A错）。相使就是以一种药为主，另一种药为辅，两药合用，辅药可以提高主药的功效（B错）。相畏就是一种药物的毒副作用能被另一种药物所抑制（C错）。相反就是两种药物同用能产生剧烈的毒副作用（E错）。